以下有关舍格伦综合征病因的描述，正确的是
A. 确切病因尚不十分明确
B. 可能与免疫系统的先天异常有关
C. 病毒性疾病改变细胞表面的抗原性
D. 有易于感染的特异性遗传因子的内在因素
E. 以上说法均正确

正确答案：E。以上说法均正确

解析：舍格伦综合征的确切病因及发病机制尚不十分明确，根据一些研究结果表明，以下三种情况可能与发病有关：①免疫系统的先天异常。②病毒性疾病改变细胞表面的抗原性，成为获得性抗原刺激，刺激B细胞活化，产生抗体，引起炎症反应。③前两种情况共同作用的结果，既有获得性外源刺激的外因，又有易于感染的特异性遗传因子的内在因素。掌握“舍格伦综合征”知识点。